与亚硝胺类化合物关系不密切的肿瘤是
A. 食管癌
B. 胃癌
C. 胆囊癌
D. 大肠癌
E. 肝癌

正确答案：C。胆囊癌

解析：亚硝胺类化合物是强致癌物，其致癌特点与化学结构有关，如不对称的亚硝胺常引起食管癌（A对）；对称的亚硝胺常引起肝癌（E对）。此外，亚硝胺类化合物还可诱发胃癌（B对）和大肠癌（D对）。胆囊癌的发生多与胆囊结石的慢性刺激有关（C错，为本题正确答案）。